患者，女，32岁。诊断为风心病二尖瓣狭窄，支持诊断的体征是
A. 心尖区舒张期隆隆样杂音
B. 心尖区收缩期吹风样杂音
C. 心尖区二尖瓣开瓣音
D. 第一心音减弱
E. 多发的重性期前收缩

正确答案：A。心尖区舒张期隆隆样杂音

解析：本例患者为青年女性，患有风心病与二尖瓣狭窄，支持诊断的体征是心尖区舒张期隆隆样杂音（A对）。心尖区收缩期吹风样杂音（B错）可见于二尖瓣关闭不全患者。心尖区二尖瓣开瓣音（C错）可见于二尖瓣狭窄且瓣膜柔顺有弹性的患者，如瓣叶钙化僵硬，则该体征消失。故心尖区二尖瓣开瓣音对风心病伴二尖瓣狭窄的诊断意义较心尖区舒张期隆隆样杂音小。第一心音减弱可（D错）见于二尖瓣关闭不全患者。多发的重性期前收缩（E错）对二尖瓣狭窄的诊断意义不大。